属于心身重新适应方面
A. 新生儿期
B. 乳儿期
C. 婴儿期
D. 幼儿期
E. 学龄期

正确答案：A。新生儿期

解析：本题考查不同年龄阶段心理卫生。新生儿期（A对）：即出生到生后28天。这是人生中的一瞬间，但这期间对人一生有极特殊的意义。主要特点表现在心身重新适应方面。一朝分娩，新生儿就要通过自身的吸吮动作来获得生存给养，具备了视、听、嗅、味、触及本体感觉，心理功能也在迅速发展。